患儿，男，5岁，臀部及下肢紫癜1天，呈对称性，色鲜红，瘙痒，发热，舌红苔薄黄，脉浮数。治疗应首选
A. 大补阴丸
B. 连翘败毒散
C. 归脾汤
D. 犀角地黄汤
E. 化斑汤

正确答案：B。连翘败毒散

解析：根据患儿发病年龄5岁，查体：臀部及下肢紫癜，呈对称性，色鲜红，故诊断为过敏性紫癜。外感风热之邪侵袭人体，由表入里，入营入血，迫血妄行，络脉损伤，血不循经，泛溢肌肤，故见臀部及下肢紫癜，呈对称性，色鲜红，瘙痒；风热外袭，正邪相争，故发热；舌红苔薄黄，脉浮数，为风热之象，故其证候为风热伤络证，治以疏风清热，凉血止血，方药为银翘散，选项中连翘败毒散其功用为辛凉解表，清热解毒，可用于治疗风热之邪引起的紫癜（B对）。大补阴丸（A错）其功用为滋阴降火，适用于阴虚火旺证。归脾汤（C错）其功用为益气补血，健脾养心，适用于心脾气血两虚证。犀角地黄汤（D错）其功用为清热解毒，凉血散瘀，适用于过敏性紫癜之血热妄行。化斑汤（E错）其功用为清气凉血，适用于气血两燔之发斑。